青霉素在大剂量注射的时候也不会进入到脑脊液中，这是因为
A. 血液屏障阻止青霉素进入脑脊液
B. 胎盘屏障阻止青霉素进入脑脊液
C. 血脑屏障阻止青霉素进入脑脊液
D. 青霉素是脂溶性物质，不能进入脑脊液
E. 青霉素不能在人体产生作用，不能进入脑脊液

正确答案：C。血脑屏障阻止青霉素进入脑脊液

解析：脑组织内的毛细血管内皮细胞之间无间隙，此种特殊的结构构成了血浆与脑脊液之间的屏障。此屏障为血脑屏障，能够阻止许多大分子物质、水溶性或解离性药物通过，青霉素也不例外。掌握“药物的吸收和分布”知识点。